减少或避免药物制剂发生药剂学配合变化的方法有
A. 改变调配次序
B. 改变溶剂
C. 调整药液pH值
D. 改变剂型
E. 控制贮存条件

正确答案：B、C、D、E。改变溶剂；调整药液pH值；改变剂型；控制贮存条件

解析：本题考查的是中药制剂的稳定性。减少或避免药物制剂发生药剂学配合变化的方法有改变溶剂（B对）、调整药液pH值（C对）、改变剂型（D对）与控制贮存条件（E对）。提高中药制剂稳定性的方法：1.延缓药物水解的方法：（1）调节pH；（2）降低温度；（3）改变溶剂；（4）制成干燥固体。2.防止药物氧化的方法：（1）降低温度；（2）避光；（3）驱逐氧气；（4）添加抗氧剂；（5）控制微量金属离子；（6）调节pH。